药品批发企业的行为规则包括
A. 建立执行药品进货检查验收制度
B. 销售药品必须准确无误，并正确说明用法、用量和注意事项
C. 有真实完整的药品购销记录
D. 设置药品检验机构
E. 从合法药品生产、经营企业购药

正确答案：A、B、C、D、E。建立执行药品进货检查验收制度；销售药品必须准确无误，并正确说明用法、用量和注意事项；有真实完整的药品购销记录；设置药品检验机构；从合法药品生产、经营企业购药